内痔用消痔液注射，一次总量是
A. 2~3ML
B. 5~10ML
C. 15~30ML
D. 20 ~30ML
E. 30~40ML

正确答案：C。15~30ML

解析：洞状静脉区注射，用1:1浓度的药液在齿线上0.1cm处进针，刺入痔体的斜上方0.5~1cm呈扇形注射，一般注药1~3ml，一次注射总量15~30ml（C对）。